某铸造工人，接触粉尘作业30年，因咳嗽、气短胸闷、胸痛而到医院诊治，医师怀疑他患硅沉着病。X线片显示有总体密集度3级的小阴影，分布范围超过4个肺区并有小阴影聚集，则诊断为
A. 观察对象
B. 壹期尘肺
C. 贰期尘肺
D. 叁期尘肺
E. 肆期尘肺

正确答案：D。叁期尘肺